男，19岁。咽痛、发热伴咳嗽2周，眼睑水肿伴肉眼血尿3天。查体：BP150/100mmHg，全身皮肤无皮疹。实验室检查：尿蛋白（++），尿红细胞30～40/HP，管型3～5/LP，补体C₃降低，SCr126μmol/L。【假设信息】若患者4天后出现尿量进行性减少，肌酐进行性升高，应首先考虑进行的检查是
A. 同位素肾动态显像
B. 肾穿刺活检
C. 泌尿系统B超
D. 清洁中段尿培养+药敏
E. 静脉肾盂造影

正确答案：B。肾穿刺活检

解析：若患者4天后出现尿量进行性减少，肌酐进行性升高，提示急性肾损伤。肾穿刺活检（B对）可明确诊断；同位素肾动态显像（A错）对发现肾脏血管病变有帮助，但不能明确诊断；泌尿系统B超（C错）可排除泌尿系统结石；清洁中段尿培养+药敏（D错）多用于泌尿系统感染诊断；急性肾损伤禁止行静脉肾盂造影（E错）检查，以免进一步加重肾衰竭。